关于药品零售企业药学服务的说法，错误的是
A. 执业药师应当向个人消费者提供用药咨询、处方、审核、调配、核对、用药指导等药学服务
B. 药品零售连锁企业总部的企业负责人是企业药学服务质量的主要负责人
C. 销售毒性中药品种时，执业药师应当做到计量准确，不得超出规定的剂量
D. 执业药师应当接受相关法律法规，药品知识等内容的岗前培训，并在《药品经营许可证》许可周期内接受不少于一次的继续培训

正确答案：D。执业药师应当接受相关法律法规，药品知识等内容的岗前培训，并在《药品经营许可证》许可周期内接受不少于一次的继续培训

解析：本题考查药学服务要求。药学服务人员应当接受相关法律法规、药品知识、药学服务管理制度、服务流程、服务标准、服务承诺、服务技能等内容的岗前培训，并每年接受继续培训（D错，为本题正确答案），确保能正确理解并履行药学服务职责。药学服务人员向个人消费者提供用药咨询、处方审核、调配、核对、用药指导、药品不良反应信息收集、跟踪随访等药学服务（A对）。企业负责人是药学服务质量的主要责任人（B对），应当负责为药学服务人员提供必要的条件，保证药学服务人员有效履行职责，满足个人消费者合理用药。销售毒性中药品种时，药学服务人员应当做到计量准确，不得超出规定的剂量（C对）。